青春期龈炎的常见病因不包括
A. 口呼吸
B. 戴矫治器
C. 乳恒牙的更替
D. 牙齿排列不齐
E. 大量牙石堆积

正确答案：E。大量牙石堆积

解析：菌斑仍是青春期龈炎的主要病因。这一年龄段的人群，由于乳恒牙的更替、牙齿排列不齐、口呼吸及戴矫治器等，造成牙齿不易清洁，加之该年龄段患者不易保持良好的口腔卫生习惯，易造成菌斑的滞留，引起牙龈炎，而牙石一般较少。掌握“青春期龈炎”知识点。